抑制粒细胞浸润炎症反应的抗痛风药物是
A. 双氯芬酸
B. 秋水仙碱
C. 苯溴马隆
D. 双醋瑞因
E. 非布司他

正确答案：B。秋水仙碱

解析：本题考查秋水仙碱的药理作用。秋水仙碱（B对）为抑制粒细胞浸润炎症反应药，用于痛风的急性期、痛风性关节炎急性发作和预防。